孕激素的生理作用下述何项是正确的
A. 使子宫肌肉对催产素的敏感性增强
B. 使阴道上皮角化，糖原增加
C. 单独使子宫内膜呈分泌期变化
D. 使宫颈口闭合，黏液减少变稠，拉丝度减少
E. 促进骨中钙的沉积

正确答案：D。使宫颈口闭合，黏液减少变稠，拉丝度减少

解析：本题考查女性生殖系统生理。孕激素使子宫颈口闭合，黏液减少，变稠，拉丝度降低（D对）。